上述各项，属伤寒严重并发症的是
A. 急性肾衰竭
B. 感染中毒性休克
C. 肠出血
D. 肠穿孔
E. ARDS

正确答案：D。肠穿孔

解析：肠穿孔是伤寒最严重的并发症（D对），多见于病程第2～3周。多发生于回肠末段。突然右下腹剧痛，伴有恶心、呕吐、冷汗、脉搏细数、呼吸急促、体温与血压下降等。随后体温又上升，并出现腹胀、腹部压痛和反跳痛、腹壁紧张等腹膜炎体征。腹部X线检查示膈下有游离气体，白细胞数较前升高并伴核左移。诱因与肠出血同，部分患者可同时并发肠出血和穿孔。